说明暴露与结局关联强度的指标是
A. RR和AR
B. RR和PAR
C. RR和PAR%
D. PAR和PAR%
E. AR和PAR

正确答案：A。RR和AR

解析：本题考查说明暴露与结局关联强度的指标。相对危险度（RR）是指暴露组发病或死亡的危险是非暴露组的多少倍，即两组危险度之比。归因危险度（AR）是暴露组发病率与对照组发病率相差的绝对值，它表示危险特异地归因于暴露因素的程度。RR与AR（A对BCDE错）都是表示暴露与结局关联强度的指标。